对盐酸乙胺丁醇描述正确的有
A. 含有两个手性碳原子
B. 有三个光学异构体
C. R，R-构型右旋异构体的活性最高
D. 在体内两个羟基氧化代谢为醛，进一步氧化为酸
E. 在体内与镁离子结合，干扰细菌RNA的合成

正确答案：A、B、C、D、E。含有两个手性碳原子；有三个光学异构体；R，R-构型右旋异构体的活性最高；在体内两个羟基氧化代谢为醛，进一步氧化为酸；在体内与镁离子结合，干扰细菌RNA的合成

解析：本题考查乙胺丁醇。乙胺丁醇含两个手性碳（A对），构型相同，故只有三个旋光异构体（B对），R,R-构型右旋体的活性最高（C对）；在体内两个羟基氧化代谢为醛，进一步氧化为酸（D对）；在体内与镁离子螯合，干扰细菌RNA的合成（E对）。